不属于根管再治疗适应证的是
A. 由根管感染所引起的根尖周病损未愈合并扩大的根管治疗牙
B. 预作修复体，X线见根管欠填，但无临床症状和体征
C. 由根管感染所引发根尖周新病损的根管治疗牙
D. 根管治疗后4～5年根尖周病损仍持续存在的根管治疗牙
E. 临产的最后1个月可行根管再治疗

正确答案：E。临产的最后1个月可行根管再治疗

解析：根管再治疗没有绝对的非适应证，一般下列情况不适合进行根管再治疗：①患牙无保存价值。②患有较严重的全身系统性疾病，一般情况差，无法耐受治疗过程。如患有严重的心脏病、糖尿病、结核或重度贫血，且全身疾病未控制。妊娠前3个月和临产的最后1个月应避免进行根管再治疗。③开口受限，无法实施操作。掌握“根管再治疗”知识点。